细胞内K⁺向外移动是通过
A. 单纯扩散
B. 通道易化扩散
C. 载体易化扩散
D. 主动转运
E. 出胞作用

正确答案：B。通道易化扩散